下列哪种疾病不是由沙门菌引起
A. 伤寒
B. 败血症
C. 食物中毒
D. 副伤寒
E. 假膜性肠炎

正确答案：E。假膜性肠炎

解析：本题考查由沙门菌引起的疾病。假膜性肠炎（E错，为本题的正确答案）是一种急性肠道炎症易发生在大手术和应用广谱抗生素后，是由难辨梭状芽胞杆菌、凝固酶阳性的溶血性耐药金黄色葡萄球菌产生毒素致病，实质是肠道内菌群生态平衡失调。人类沙门菌感染有4个类型：1.肠热症：包括伤寒沙门菌引起的伤寒（A对），以及甲型副伤寒沙门菌、肖氏沙门菌（原称乙型副伤寒沙门菌）、希氏沙门菌引起的副伤寒（D对）；2.胃肠炎（食物中毒）（C对）是最常见的沙门菌感染，约占70％；3.败血症（B对）；4.无症状带菌者。